一位38岁的男患者，左上67间牙龈反复肿胀半年，经常食物嵌塞，应做的进一步检查，除了
A. 邻面龋
B. 两牙接触关系
C. 两牙牙冠外形
D. 对颌牙齿情况
E. 活体组织检查

正确答案：E。活体组织检查

解析：本题考查食物嵌塞的检查。活体组织检查（E错，为本题正确答案）是检查肿物，如肿瘤的性质、分化程度的方法，与食物嵌塞的检查无关。邻面龋（A对）使两邻牙失去正常接触关系（B对），出现缝隙，食物可嵌入其中；两牙牙冠外形（C对）异常，如食物溢出道消失致使食物挤入牙间隙；对颌牙形态异常（D对），有尖锐牙尖可将食物压入牙间隙；这些情况都要进一步检查，对因治疗以解决嵌塞的问题。